人工被动免疫制剂是
A. 抗毒血清
B. 活菌苗
C. 死菌苗
D. 活疫苗
E. 死疫苗

正确答案：A。抗毒血清

解析：本题考查人工被动免疫制剂。人工被动免疫是将含有特异性抗体的血清或制剂接种人体，使机体被动地获得特异性免疫力而受到保护。人工被动免疫制剂包括免疫血清（A对）和免疫球蛋白。活菌苗（B错）、死菌苗（C错）、活疫苗（D错）和死疫苗（E错）均属于人工自动免疫制剂。